肺血栓栓塞症的继发性危险因素中，属于独立危险因素的是
A. 创伤
B. 年龄
C. 骨折
D. 口服避孕药
E. 肿瘤家庭史

正确答案：B。年龄

解析：继发性危险因素是指后天获得的易发生DVT和PTE的多种病理和病理生理改变，继发性危险因素，可以单独存在，也可以同时存在、协同作用，其中年龄（B对）是独立的危险因素，随着年龄增加，血脂增高，血管内皮损伤增加，血栓形成的机会增加，肺血栓栓塞发病率也逐渐增高。创伤（A错）、骨折（C错）、口服避孕药（D错）、有肿瘤家庭史（E错）是肺栓塞的继发性危险因素，但不是独立的危险因素，需要在其他的危险因素存在的条件下，才可以导致肺血栓栓塞。